应激时心血管系统的变化中下列哪一项不存在？
A. 心肌收缩力减弱
B. 心率增快
C. 心律失常
D. 血管收缩
E. 心肌耗氧增多

正确答案：A。心肌收缩力减弱

解析：应激时心血管系统的变化有心肌收缩力增强（A错，为本题正确答案）、心率增快（B对）、心律失常（C对），血管收缩（D对）、心肌耗氧量增多（E对）。